—般情况之下,年轻恒牙的萌出是牙根形成多少开始
A. 1/4
B. 1/3
C. 2/3
D. 3/4
E. 2/5

正确答案：C。2/3

解析：本题考查年轻恒牙的特点。—般情况之下，年轻恒牙的萌出是牙根形成2/3（C对）开始。恒牙一般在牙根形成2/3左右时开始萌出，萌出后牙根继续发育，于萌出后2～3年牙根才达到应有的长度，3～5年根尖才发育完成。年轻恒牙牙龈缘附着的位置不稳定，随牙的萌出而不断退缩，需3～4年才稳定。大部分恒牙自萌出后达到（牙合）平面需7～12个月。